地方性克汀病
A. 经食物链传递而富集最终影响人体健康的是
B. 胚胎期和婴儿发育早期机体严重碘缺乏可引起
C. 污水灌溉农田使农作物受污染而危害人体健康的是
D. 引起居民以斑釉齿和骨骼损害为特征的疾病是
E. 以皮肤损害为显著特点的生物地球化学性疾病为

正确答案：B。胚胎期和婴儿发育早期机体严重碘缺乏可引起

解析：本题考查地方性克汀病。胚胎期和婴儿发育早期机体严重碘缺乏可引起（B对ACDE错）地方性克汀病。地方性克汀病原系指欧洲阿尔卑斯山区常见的一种体格发育落后、痴呆和聋哑的疾病。这是在碘缺乏地区出现的一种比较严重碘缺乏病的表现形式。患者生后即有不同程度的智力低下，体格矮小，听力障碍，神经运动障碍和甲状腺功能低下，伴有甲状腺肿。可概括为呆、小、聋、哑、瘫，每年有近千万婴儿因缺碘导致智力损伤。